形成马尾的结构
A. C5~T2
B. 骶神经根
C. 骶、尾神经根
D. 腰、骶、尾神经根
E. 胸神经根

正确答案：D。腰、骶、尾神经根

解析：腰、骶、尾神经根（D对）在脊髓圆锥下方，围绕终丝聚集成束，形成马尾。